疫气发生流行的因素
A. 气候反常
B. 源污染
C. 六淫外感
D. 隔离不当
E. 饮食不节

正确答案：A、B、D、E。气候反常；源污染；隔离不当；饮食不节

解析：本题考查疫气发生流行的因素。疫气发生流行的因素气候反常（A对）、源污染（B对）、隔离不当（D对）、饮食不节（E对）。疠气，即疫疠邪气，是一类具有强烈传染性的外感致病邪气，又称“戾气”“异气”“毒气”“乖戾之气”等。疠气与一般的六淫邪气不同，乃是天地间别有的一种特殊的致病因素。疠气致病，多从口鼻侵入人体。在人群中，可以散在发生，也可以形成瘟疫大面积流行。疫疠邪气所致疾病称“疫病”，如大头瘟、疫痢、白喉、烂喉丹痧、天花、霍乱、鼠疫等。疫疠发生与流行的影响因素如下：（1）气候因素。自然界气候的反常变化，如久旱、酷热、湿雾瘴气等。（2）环境和饮食。如空气、水源、或食物受到污染。（3）没有及时做好预防隔离工作。（4）社会因素之影响。六淫致病的共同特点：①外感性（C错）：六淫为病，其发病途径，多首先侵犯肌表，或从口鼻而入，或两者同时侵袭。②季节性：六淫致病常有明显的季节性，与气候变化密切相关。③地域性：六淫致病与生活、工作区域环境密切相关。④相兼性：六淫邪气既可单独侵袭人体而致病，又可两种以上同时侵犯人体而致病。